患者，女，38岁。眩晕，自汗，心悸，失眠，多梦，腹胀便溏，食少，体倦，面色无华。其证型是
A. 水气凌心
B. 心肾不交
C. 肺脾气虚
D. 心脾两虚
E. 心肝血虚

正确答案：D。心脾两虚

解析：脾气亏损，气血生化不足，心失所养，心神不安，则心悸怔忡，失眠多梦，健忘；头面失养，故头晕，面色萎黄；脾虚气弱，运化失职，水谷不化，故食欲不振而食少，腹胀，便溏；脾气亏虚，摄血无力，血不归经，则见各种慢性出血，血色淡；倦怠乏力，舌质淡嫩，脉弱，均为气血亏虚之症（D对）。